流行病学研究的用途是
A. 探索病因及影响因素
B. 评价预防策略和措施的效果
C. 疾病监测
D. 研究疾病的自然史
E. 以上都对

正确答案：E。以上都对